属于直接凝血酶抑制剂的抗凝血药是
A. 依诺肝素
B. 肝素
C. 华法林
D. 利伐沙班
E. 达比加群酯

正确答案：E。达比加群酯

解析：本题考查直接凝血酶抑制剂。直接凝血酶抑制剂：主要抑制凝血Ⅱa和Xa因子，主要药品有水蛭素、重组水蛭素、达比加群酯（E对）。依诺肝素（A错）临床用于预防深静脉血栓形成。肝素（B错）是一种抗凝剂，用于防治血栓形成或栓塞性疾病。华法林（C错）为可抑制维生素K环氧化酶活动的抗凝血药。利伐沙班（D错）为可直接抑制凝血因子Xa，并与抗凝血酶Ⅲ结合的抗凝血药。